9663-1996）对以下项目提出了卫生要求，除了
A. 小气候
B. 氨
C. 噪声
D. 二氧化碳
E. 新风量

正确答案：B。氨

解析：本题考查我国原卫生部发布的《旅店业卫生标准》（GB 9663-1996）提出的卫生要求的项目。我国原卫生部发布的《旅店业卫生标准》（GB 9663-1996）对三类旅店分别制订了微小气候（A对）、一氧化碳、二氧化碳（D对）、可吸入颗粒物、细菌总数、照度、噪声（C对）、新风量（E对）、床位面积等指标的限值，除了氨（B错，为本题正确答案）。